毛果芸香碱对眼睛的作用为
A. 扩瞳、调节麻痹
B. 扩瞳、升高眼内压
C. 缩瞳、调节痉挛
D. 扩瞳、降低眼内压
E. 缩瞳、升高眼内压

正确答案：C。缩瞳、调节痉挛

解析：毛果芸香碱（匹鲁卡品）对眼的作用表现降低眼内压、缩瞳、调节痉挛（C对）。